联合用药罗红霉素主要干扰辛伐他汀的
A. 体内吸收
B. 体内分布
C. 肝脏代谢
D. 肾脏排泄
E. 肠道排泄

正确答案：C。肝脏代谢

解析：本题考查联合用药。罗红霉素能够抑制肝药酶，使辛伐他汀代谢减慢（C对）。